患者晨起发现刷牙时右侧口角漏水，照镜发现右侧口角下垂、眼睑闭合不全。就诊后查体，右侧口腔颊、舌及口底黏膜较对侧干燥、无光泽；右侧舌前2/3味觉较对侧迟钝；听力较对侧差；Schirmer试验发现右侧泪液分泌少于对侧。该患者面神经损害的部位可能在
A. 茎乳孔以外
B. 鼓索与镫骨肌神经节之间
C. 膝状神经节
D. 膝状神经节以上
E. 镫骨肌神经节与膝状神经节之间

正确答案：C。膝状神经节

解析：本题考查面神经麻痹的诊断。本患者晨起发现刷牙时右侧口角漏水，照镜发现右侧口角下垂、眼睑闭合不全，说明出现面瘫症状。右侧口腔颊、舌及口底黏膜较对侧干燥、无光泽；右侧舌前2/3味觉较对侧迟钝，说明味觉出现障碍。听力较对侧差，说明听觉出现障碍，表明镫骨肌的功能受损。Schirmer试验发现右侧泪液分泌少于对侧，说明右侧泪腺分泌障碍。表明膝状神经节受损。当面神经损害部位在膝状神经节时，会出现面瘫+味觉丧失+唾液腺、泪腺分泌障碍+听觉改变症状。因此该患者面神经损害的部位可能在膝状神经节（C对）。当面神经损害部位在茎乳孔以外（A错）时，表现为面瘫。当面神经损害部位在鼓索与镫骨肌神经节之间（B错）时，出现面瘫+味觉丧失+唾液腺分泌障碍。当面神经损害部位在膝状神经节以上（D错）时，除面瘫外，感觉与分泌功能障碍一般均较轻。当面神经损害部位在镫骨肌神经节与膝状神经节之间（E错）时，会出现面瘫+味觉丧失+唾液腺分泌障碍+听觉改变症状。